用于氰化物中毒解救的药物是
A. 纳洛酮
B. 氟马西尼
C. 青霉胺
D. 乙酰半胱氨酸
E. 亚甲蓝

正确答案：E。亚甲蓝

解析：本题考查中毒解救。用于氰化物中毒解救的药物是亚甲蓝（美蓝）（E对）。亚甲蓝用于氰化物中毒，小剂量可治疗高铁血红蛋白血症。纳洛酮（A错）用于急性阿片类中毒及急性乙醇中毒。氟马西尼（B错）用于苯二氮䓬类药物过量或中毒。青霉胺（C错）用于铜、汞、铅中毒的解毒，治疗肝豆状核变性病。乙酰半胱氨酸（D错）用于对乙酰氨基酚过量所致的中毒。